儿童多吃精制糖引起的最常见健康问题
A. 糖尿病
B. 龋齿
C. 癌症
D. 动脉硬化
E. 脂肪肝

正确答案：B。龋齿